下列垫底材料中对牙髓毒性作用最小的是
A. 氧化锌丁香油酚黏固剂
B. 氢氧化钙制剂
C. 磷酸锌黏固剂
D. 聚羧酸锌黏固剂
E. 玻璃离子黏固剂

正确答案：B。氢氧化钙制剂

解析：本题考查对牙髓毒性作用最小的垫底材料。氢氧化钙制剂（B对）具有强碱性，对龋坏牙本质的细菌有一定的杀菌及抑菌作用，可杀死龋洞中残留的细菌，用此种材料盖髓可促进修复性牙本质的形成，是以上材料中对牙髓毒性作用最小的垫底材料。氧化锌丁香油酚黏固剂（A错）虽然对牙髓的刺激性比较小，有安抚、抗炎、抑菌的作用，但是接触牙髓时可引起局限性慢性炎症反应。磷酸锌黏固剂（C错）在固化的时候呈酸性，可刺激牙髓使牙髓发生反应，甚至会造成牙髓坏死。聚羧酸锌黏固剂（D错）对牙髓刺激性较小，与氧化锌丁香酚水门汀相近。玻璃离子黏固剂（E错）对牙髓的刺激性与聚羧酸锌黏固剂相似。